以下关于沟固位形的说法哪项是错误的
A. 深度一般为1mm
B. 可抗水平脱位和（牙合）向脱位
C. 与颈1/3方向一致
D. 对修复体有加固作用
E. 与就位道方向一致

正确答案：C。与颈1/3方向一致

解析：本题考查沟固位形。关于沟固位形的说法错误的是与颈1/3方向一致（C错，为本题的正确答案）。沟固位形是辅助固位形的一种，要与就位道方向一致（E对），以保证修复体顺利就位，而不是与颈1/3方向一致。沟固位形有一个面不被牙体组织包围，进入牙体组织深度一般为1mm（A对）,所以可以抵抗水平脱位和（牙合）向脱位（B对），且对于修复体有加固作用（D对），即提高固位力。